下列关于火热内生机制的叙述，错误的是
A. 气有余便是火
B. 邪郁化火
C. 五志过极化火
D. 精亏血少，阴虚阳亢
E. 外感暑热阳邪

正确答案：E。外感暑热阳邪

解析：病理情况下，阳气过盛，机能亢奋，必然使物质的消耗增加，以致伤阴耗津。此种病理性的阳气过亢称为“壮火”，又称为“气有余便是火”（A对）。邪郁化火（B对）包括两个方面，一是外感六淫病邪，在疾病过程中，皆可郁滞而从阳化热化火；二是体内的病理性代谢产物和食积、虫积等，亦能郁而化火。五志过极化火（C对）多由于情志刺激，影响了脏腑精气阴阳的协调平衡，造成气机郁结或亢逆。气郁日久则可化热，气逆自可化火，因之火热内生。由于阴气大伤，阴虚不能制阳，阳气相对亢盛（D对），阳亢化热化火，虚热虚火内生（E错，为本题正确答案）。